丝虫病可引起的尿液改变是
A. 乳糜尿
B. 血红蛋白尿
C. 胆红素尿
D. 脓尿
E. 血尿

正确答案：A。乳糜尿

解析：尿中混有淋巴液而呈稀牛奶状称为乳糜尿（A对），常见于丝虫病及肾周围淋巴管梗阻。血红蛋白尿（B错）主要见于严重的血管内溶血，如溶血性贫血、血型不合的输血反应。胆红素尿（C错）由于尿中有大量的结合胆红素，尿液呈豆油样改变，常见于胆汁淤积性黄疸和肝细胞性黄疸。脓尿（D错）见于泌尿系统感染如肾盂肾炎、膀胱炎等。血尿（E错）多见于泌尿系统炎症、结石、肿瘤、结核、外伤等，也可见于血液系统疾病，如血友病、血小板减少性紫癜等。